患者，女性，30岁，左上7残冠，已行根管治疗，现拟行冠修复保护。左上7暂时冠的最常用材料为
A. 热凝树脂
B. 光固化义齿基托树脂
C. 硅橡胶
D. 自凝树脂
E. 丙烯酸酯类软塑材料

正确答案：D。自凝树脂

解析：本题考查暂时冠最常用的材料。临床上做暂时冠时，最常用的材料为自凝树脂（D对）。自凝树脂操作方便、容易控制成形等优点，常用于制作暂时冠、正畸活动矫治器、牙周夹板及义齿重衬等。热凝树脂（A错）常用于制作全口义齿及活动义齿的基托、牙周夹板、保持器等。光固化义齿基托树脂（B错）主要用于制作全口义齿及活动义齿暂基托等。硅橡胶（C错）主要用来取印模。丙烯酸酯类软塑材料（E对）可用于取印模、义齿基托重衬等。